最易发生抗原变异的病毒是
A. 流行性感冒病毒
B. 腮腺炎病毒
C. 乙型肝炎病毒
D. 狂犬病毒
E. 冠状病毒

正确答案：A。流行性感冒病毒

解析：本题考查最易发生抗原变异的病毒。最易发生抗原变异的病毒是流行性感冒病毒（A对）。腮腺炎病毒（B错）仅有一个血清型，其预防以隔离患者，减少传播机会和接种疫苗为主。乙型肝炎病毒（C错）目前采用的是病毒DNA转染的细胞培养系统，HBV基因组与细胞DNA整合并可长期稳定表达HBV抗原成分。狂犬病毒（D错）的重要抗原为病毒包膜糖蛋白G和核蛋白N，不同来源的狂犬病毒分离株的抗原性不同，主要是由于病毒包膜糖蛋白G的抗原性差异。冠状病毒（E错）大部分感染动物，目前从人分离的冠状病毒主要有普通冠状病毒229E、OC43和SARS冠状病毒（SARS-CoV）三个型别。